瞳孔扩大见于（）中毒
A. 有机磷杀虫药
B. 吗啡
C. 氯丙嗪
D. 阿托品
E. 亚硝酸盐

正确答案：D。阿托品